对于孕妇、乳母，其体内摄入氮与排出氮之间的关系为
A. I＝（U＋F＋S）
B. I﹥（U＋F＋S）
C. I﹤（U＋F＋S）
D. 正相关
E. 负相关

正确答案：B。I﹥（U＋F＋S）